早产儿使用铁剂预防贫血起始的月龄是
A. 1个月
B. 2个月
C. 3个月
D. 4个月
E. 5个月

正确答案：B。2个月

解析：成熟儿生后4个月至3岁每日约需铁1mg/kg，早产儿约需2mg/kg（P356），因此早产儿更易发生缺铁性贫血。故对于早产儿，宜从2个月左右开始给予铁剂预防（B对）。